受血者配血试验的血标本必须是输血前
A. 2天之内的
B. 3天之内的
C. 4天之内的
D. 5天之内的
E. 6天之内的

正确答案：B。3天之内的

解析：配血标本必须是输血前3天之内的（B对），超过3天的标本不能代表当前病人的免疫学状态。特殊情况下（如妊娠、病人血管条件差、采血困难者）也可例外，适当延长到5天。合格血样如不需配血，应按送检时间分别放入4℃冰箱内保存，输血标本至少保存7天。